可与吸入性糖皮质激素合用的长效β₂受体激动剂是
A. 多索茶碱
B. 孟鲁司特
C. 沙美特罗
D. 噻托溴铵
E. 沙丁胺醇

正确答案：C。沙美特罗

解析：本题考查沙美特罗。可与吸入性糖皮质激素合用的长效β₂受体激动剂是沙美特罗（C对）。沙美特罗为长效β₂受体激动剂，不推荐单独使用，须与吸入型肾上腺皮质激素联合应用，不适合初始用于快速恶化的急性哮喘发作，仅用于需要长期用药的患者。多索茶碱（A错）为黄嘌呤类药物。孟鲁司特（B错）为白三烯受体阻断剂。噻托溴铵（D错）为M胆碱受体阻断剂。沙丁胺醇（E错）为短效β₂受体激动剂。